阿司匹林含量测定应采用的方法是
A. 酸碱滴定法
B. 非水溶液滴定法
C. 氧化还原滴定法
D. 气相色谱法
E. 高效液相色谱法

正确答案：A。酸碱滴定法

解析：本题考查阿司匹林的含量测定方法。阿司匹林分子中具有羧基，原料药可采用酸碱滴定法（A对）测定含量。